推动医务人员医学道德评价的直接标准是
A. 社会习俗
B. 个人修养
C. 内心信念
D. 社会舆论
E. 完美效果

正确答案：C。内心信念

解析：推动医务人员医学道德评价的直接标准是内心信念。掌握“医学道德评价”知识点。